适宜制成混悬型液体药剂的药物有
A. 需制成液体药剂供临床应用的难溶性药物
B. 为了发挥长效作用而需制成液体药剂供临床应用的药物
C. 需要提高在水溶液中稳定性的药物
D. 毒性药物
E. 剂量小的药物

正确答案：A、B、C。需制成液体药剂供临床应用的难溶性药物；为了发挥长效作用而需制成液体药剂供临床应用的药物；需要提高在水溶液中稳定性的药物